克罗恩病诊断最有意义的检查方法是
A. 腹部B超
B. 腹部CT
C. 粪便潜血检查
D. 胃镜
E. 结肠镜

正确答案：E。结肠镜

解析：胃肠钡剂造影能较好地显示胃肠黏膜形态，可见肠黏膜皱襞粗乱、纵行性溃疡或裂沟、鹅卵石征、假息肉、多发性狭窄或肠壁僵硬、瘘管形成等典型征象，由于本题答案选项无结肠镜，故最佳答案为结肠镜（E对）。腹部B超（A错）、腹部CT（B错）虽可显示肠壁增厚、腹腔或盆腔脓肿、包块等，而有助于克罗恩病的诊断，但不能观察胃黏膜形态，对诊断克罗恩病不是最有意义的检查方法。粪便潜血检查（C错）用于了解消化道有无出血，对克罗恩病诊断无意义。胃镜（D错）主要用于检查食管、胃、十二指肠疾病，克罗恩病主要位于末端回肠和邻近结肠，胃镜对克罗恩病诊断意义不大。现九版内科学主张胃肠钡剂造影及钡剂灌肠检查阳性率比较低，已被内镜及CTE/MRE所代替，原正确答案为E。